属于口服速释制剂的是
A. 硝苯地平渗透泵片
B. 利培酮口崩片
C. 利巴韦林胶囊
D. 注射用紫杉醇脂质体
E. 水杨酸乳膏

正确答案：B。利培酮口崩片

解析：本题考查口服速释剂的类型。利培酮口崩片（B对）属于口服速释剂，口服速释剂包括舌下片、分散片和口崩片。硝苯地平渗透泵片（A错）属于控释制剂；注射用紫杉醇脂质体（D错）属于靶向制剂。